下列腧穴在五行配属中，属“金”的是
A. 少府
B. 大陵
C. 阳溪
D. 后溪
E. 经渠

正确答案：E。经渠

解析：根据阳井金，阴井木进行配属。阴经的井荥输经合属木火土金水，阳经的井荥输经合属金水木火土。经渠是肺经的输穴属金（E对）。少府是心经的荥穴属火（A错）。大陵是心包经的输穴属土（C错）。阳溪是大肠经的经穴属火（D错）。后溪是小肠经的输穴属木（D错）。